与金黄色葡萄球菌毒力有关的因素
A. 形成血浆凝固酶的能力
B. 特异性细胞糖类的存在
C. 耐药性
D. 透明质酸酶
E. 磷酸酶活力

正确答案：A。形成血浆凝固酶的能力

解析：形成血浆凝固酶的能力与金葡菌的致病力（即毒力）相关（A对），凝固酶使血浆中的纤维蛋白沉积于细菌表面，阻碍吞噬细胞的吞噬或消化作用，还能保护病菌不受血清中杀菌物质的破坏。特异性细胞糖类的存在（B错）能抑制炎症应答，抑制吞噬，有毒素样活性，但与金葡菌毒力无关。耐药性是指微生物、寄生虫或肿瘤细胞对于化疗药物作用的耐受性，与毒力无关（C错）。透明质酸酶（D错）、磷酸酶活力（E错）与β溶血性链球菌的毒力有关。